午后热甚，身热不扬者属
A. 气虚发热
B. 阳明潮热
C. 湿温潮热
D. 阴虚潮热
E. 小儿夏季热

正确答案：C。湿温潮热

解析：湿邪黏腻，湿遏热伏，故身热不扬；午后阳气盛，故午后发热明显；是湿热证特有的一种热型，常见于湿温病（C对）。气虚发热指长期微热，劳累则甚，兼倦怠疲乏、少气、自汗等症（A错）。阳明潮热指日晡（下午3～5时，即申时）发热明显，且热势较高，亦称为日晡潮热。兼见口渴饮冷、腹胀便秘等表现（B错）。阴虚潮热指午后和夜间有低热，兼见颧红、盗汗、五心烦热（即胸中烦、手足心发热而喜就凉处）等症；严重者，感觉有热自骨内向外透发（D错）。小儿夏季热（E错）指小儿于夏季气候炎热时长期发热，兼有烦渴、多尿、无汗等表现。